生产时应建立完整的生产记录，并保存五年备查的药品是
A. 麻醉药品
B. 精神药品
C. 毒性药品
D. 放射性药品
E. 戒毒药品

正确答案：C。毒性药品

解析：本题考查毒性药品。生产时应建立完整的生产记录，并保存五年备查的药品是毒性药品（C对）。医疗用毒性药品（简称毒性药品）是指毒性剧烈，治疗剂量与中毒剂量相近，使用不当会致人中毒或死亡的药品。生产毒性药品及其制剂，必须严格执行生产工艺操作规程，投料应在本企业药品检验人员的监督下准确投料，并建立完整的生产记录，保存五年备查。麻醉药品（A错）是指连续使用后易产生身体依赖性、能成瘾癖的药品。精神药品（B错）是指直接作用于中枢神经系统，使之兴奋或抑制，连续使用可产生依赖性的药品。放射性药品（D错）是指用于临床诊断或者治疗的放射性核素制剂或者其标记化合物。戒毒药品（E错）是指控制并消除滥用阿片类药物成瘾者的急剧戒断症状与体征的药品。